急性白血病的特点是
A. 全血细胞减少
B. 嗜碱性粒细胞增多
C. 骨髓中原始细胞明显增多
D. 酸化溶血试验阳性
E. 网织红细胞增多

正确答案：C。骨髓中原始细胞明显增多

解析：急性白血病的特点是骨髓中原始细胞明显增多（C对），白细胞明显增多，全血细胞增多（A错），嗜碱性粒细胞多正常（B错），网织红细胞多正常（E错），酸化溶血试验阴性（D错）。